下列各项，不属《希波克拉底誓言》内容的是
A. 为病家谋利益
B. 强调医学是艺术
C. 强调医生品德修养
D. 强调尊重同道
E. 为病家保密

正确答案：B。强调医学是艺术

解析：《希波克拉底誓言》是医学伦理学的最早文献，其要旨是医生应根据自己的‘能力和判断’，采取有利于患者的措施，保守患者的秘密。其主要内容包括：第一，阐明了行医的宗旨，是‘遵守为病家谋利益之信条（A的）。第二，强调医生的品德修养（C对）。第三，要求尊重同道（D对）。第四，提出了为病家保密的道德要求。第五，提出了行医的品质和作风（E对）。（B错，为本题正确答案）。